在八脉交会中，与后溪相通的奇经是
A. 任脉
B. 督脉
C. 阳维脉
D. 阳跷脉
E. 冲脉

正确答案：B。督脉

解析：本题考查八脉交会穴。列缺通过手太阴肺经循喉咙，与任脉相通（A错）。后溪通过手太阳小肠经交肩会于大椎，与督脉相通（B对）。外关通过手少阳三焦经上肩循臑会、天髎、肩井，与阳维脉相通（C错）。申脉通过足太阳膀胱经经跗阳、仆参，与阳跷脉（D错）相通。 公孙通过足太阴脾经入腹会于关元，与冲脉相通（E错）。记忆：牢记八脉交会八穴歌。